生命质量的基础是
A. 社会经济、文化背景、价值取向
B. 社会经济、宗教信仰、社会阶层
C. 政治制度、社会经济、文化背景
D. 社会经济、医疗卫生服务、文化背景
E. 社会经济、价值取向、行为生活方式

正确答案：A。社会经济、文化背景、价值取向

解析：本题考查生命质量的基础。生命质量的基础是社会经济、文化背景、价值取向（A对BCDE错）。